认为龋病是由早期附着在牙面上的细菌和酶对釉质中有机基质的蛋白溶解作用开始的，而不是釉质初期的脱矿的是以下哪种学说
A. 化学细菌学说
B. 蛋白溶解学说
C. 广义龋病生态学假说
D. 龋病病因的四联因素理论
E. 蛋白溶解-螯合学说

正确答案：E。蛋白溶解-螯合学说

解析：本题考查龋病概述。蛋白溶解-螯合学说（E对）由Schatz和Manin等（1955）提出。他们认为龋病是由早期附着在牙面上的细菌和酶对釉质中有机基质的蛋白溶解作用开始的，而不是釉质初期的脱矿。 1.化学细菌学说（A错）：由Miller在1890年提出，此学说认为龋病的发生是由于寄生在牙面上的细菌与口腔内碳水化合物作用，发酵产酸，使牙齿硬组织内的无机物脱矿溶解，而后蛋白溶解酶分泌将有机物分解，最终牙体缺损。此学说不足之处在于没有阐明牙面细菌存在的形式，没有明确提出龋病的发生与致龋细菌、致龋食物及酸溶解的关系，但该学说为龋病病因的现代理论奠定了基础。2.蛋白溶解学说（B错）：由Gottlieb和Frisbie于1947年提出，该学说认为牙面上细菌产生的蛋白水解酶首先使牙体局部有机物分解，打开了细菌侵入牙体的通道，致使细菌通过釉质的有机途径侵入，产酸使无机物溶解脱矿，形成龋损。3.蛋白溶解--螯合学说：该学说由Schatz和Martin于1955年提出，此学说认为龋病是由早期附着在牙面上的细菌和酶对釉质中有机基质的蛋白溶解作用开始的，而不是釉质初期的脱矿。通过蛋白溶解释放出各种螯合剂，如有机酸，继之螯合剂溶解羟磷灰石晶体，形成龋病损害。4.龋病病因的现代概念：60年代Keyes在Miller的学说基础上提出龋病的三联因素理论，明确提出龋病是由细菌、食物和宿主三方面的因素共同作用下产生的，70年代有学者认为时间因素也必须考虑，因此将三联因素发展成四联因素（D错）。龋病的发生要求有口腔致龋菌群以及致龋的食物，有足够的时间共同作用于 对龋病敏感的宿主。一般认为pH值达到5.5以下时，才能导致釉质脱矿。5.广义龋病生态学假说（C错）认为，龋病是一种内源性疾病，由于牙面生态系统中共生和寄生微生物，通过产酸和耐酸阶段的适应和选择而发生变化，在微生物的综合作用下开始龋病过程。我们发现身边越来越多的疾病在不断出现，包括过敏、内分泌紊乱、各种肿瘤、癌症、心血管疾病、糖尿病等等，这些疾病的共同特征是它们与人体外部的细菌、病毒没有关系，而是因人体自身机能的失调或功能的下降所致。也无法靠杀菌、消炎来获得治疗。这些疾病就是内源性疾病。